根据《医疗机构药事管理规定》，下列关于医疗机构药事管理要求的说法，正确的是
A. 三级医疗机构应当成立药事管理与药物治疗学组
B. 二级以上医疗机构药学部门负责人应当具有高等学校药学专业或者临床药学专业本科以上学历，及本专业高级技术职务任职资格
C. 医疗机构药学专业技术人员不得少于本机构卫生专业技术人员的6%
D. 医疗机构药事管理是以药品为中心、以药品调剂为基础的药学技术服务和相关药品管理工作

正确答案：B。二级以上医疗机构药学部门负责人应当具有高等学校药学专业或者临床药学专业本科以上学历，及本专业高级技术职务任职资格

解析：本题考查的是药学部门的人员要求。根据《医疗机构药事管理规定》，下列关于医疗机构药事管理要求的说法，正确的是二级以上医疗机构药学部门负责人应当具有高等学校药学专业或者临床药学专业本科以上学历，及本专业高级技术职务任职资格（B对）。药学部门负责人的要求：二级以上医院药学部门负责人应当具有高等学校药学专业或者临床药学专业本科以上学历，及本专业高级技术职务任职资格；除诊所、卫生所、医务室、卫生保健所、卫生站以外的其他医疗机构药学部门负责人应当具有高等学校药学专业专科以上或者中等学校药学专业毕业学历，及药师以上专业技术职务任职资格。《医疗机构药事管理规定》将原先的药事管理委员会更名调整为药事管理与药物治疗学委员会，明确二级以上医院应当设立药事管理与药物治疗学委员会（A错），其他医疗机构应当成立药事管理与药物治疗学组。药事管理与药物治疗学委员会（组）应当建立健全相应工作制度，日常工作由药学部门负责。药学专业技术人员配备比例：《医疗机构药事管理规定》规定，医疗机构药学专业技术人员不得少于本医疗机构卫生专业技术人员的8%（C错）。二级综合医院药剂科的药学人员中，具有高等医药院校临床药学专业或者药学专业全日制本科毕业以上学历的，应当不低于药学专业技术人员总数的20%，药学专业技术人员中具有副高级以上药学专业技术职务任职资格的应当不低于6%；三级综合医院药学部药学人员中具有高等医药院校临床药学专业或者药学专业全日制本科毕业以上学历的，应当不低于药学专业技术人员的30%,药学专业技术人员中具有副高级以上药学专业技术职务任职资格的，应当不低于13%，教学医院应当不低于15%。医疗机构药事管理是保证医疗机构药品质量、保障公众用药安全、维护公众身体健康相关的活动（D错）。